硫酸阿托品需要检査的特殊杂质是
A. 麻黄碱
B. 罂粟碱
C. 莨菪碱
D. 阿扑吗啡
E. 其他金鸡纳碱

正确答案：C。莨菪碱

解析：本题考查药物中杂质的检查。硫酸阿托品需要检査的特殊杂质是莨菪碱（C对）。硫酸阿托品为莨菪碱的消旋体，若生产过程中消旋化不完全即会引入莨菪碱，后者的毒性较大，故应进行限量检查。麻黄碱（A错）及阿扑吗啡（D错）不属于特殊杂质。罂粟碱（B错）是吗啡需要检查的特殊杂质。金鸡纳碱（E错）是硫酸奎宁需要检查的特殊杂质。